根据《关于进一步改革完善药品生产流通使用政策的若干意见》，国家将实施药品领域全链条、全流程的重大改革，下列关于推动药品流通体制改革措施的说法错误的是
A. 鼓励药品流通企业批发零售一体化经营
B. 力争到2018年底实现零售药品分级分类管理，全面实现零售连锁化
C. 整治药品流通领域的突出问题，严厉打击租借证照等违法违规行为
D. 规范零售药店互联网零售服务，推广“网订店取”“网订店送”等新型配送

正确答案：B。力争到2018年底实现零售药品分级分类管理，全面实现零售连锁化

解析：本题考查的是药品流通政策与改革措施。根据《关于进一步改革完善药品生产流通使用政策的若干意见》，国家将实施药品领域全链条、全流程的重大改革，下列关于推动药品流通体制改革措施的说法错误的是力争到2018年底实现零售药品分级分类管理，全面实现零售连锁化（B错，为本题正确答案）。药品流通政策与改革措施：流通环节重点是整顿流通秩序，推进药品流通体制改革。一是推动药品流通企业转型升级，健全城乡药品流通网络（A对）。推进零售药店分级分类管理，提高零售连锁率。鼓励药品流通企业参与国际药品采购和营销网络建设。二是整治药品流通领域突出问题，严厉打击租借证照、虚假交易、伪造记录、非法渠道购销药品、商业贿赂、价格欺诈、价格垄断以及伪造、虚开发票等违法违规行为（C对），依法严肃惩处违法违规企业和医疗机构，严肃追究相关负责人的责任，并记入不良信用记录，涉嫌犯罪的，及时移送司法机关处理。三是建立药品价格信息可追溯机制，促进价格信息透明。四是积极发挥“互联网+药品流通”的优势和作用，方便群众用药。规范零售药店互联网零售服务，推广“网订店取”“网订店送”等新型配送方式（D对）。鼓励有条件的地区依托现有信息系统，开展药师网上处方审核、合理用药指导等药事服务。